1～2ml剂量所对应的给药方法是
A. 静脉注射
B. 椎管注射
C. 肌内注射
D. 皮下注射
E. 皮内注射

正确答案：D。皮下注射

解析：本题考查注射给药的给药部位和吸收途径。皮下注射（D对）用量通常为1～2ml；静脉注射（A错）一般剂量超过10ml；椎管注射（B错）剂量不得超过10ml；肌内注射（C错）的一般用量为1～5ml；皮内注射（E错）注射量在0.2ml以内。